消化道平滑肌细胞的静息电位主要由哪种离子组成
A. 钾离子外流
B. 钾离子内流
C. 钠离子外流
D. 钠离子内流
E. 钙离子内流

正确答案：A。钾离子外流